牙骨质与骨组织的相同之处，除外
A. 呈层板状排列
B. 可以新生
C. 有陷窝
D. 有细胞
E. 无血管

正确答案：E。无血管

解析：本题考查牙骨质。牙骨质与骨组织的相同之处，除外无血管（E错，为本题的正确答案）。牙骨质是覆盖于牙根表面的一层硬结缔组织，其组织学结构与密质骨相似，呈层板状排列（A对）；可以新生，牙骨质细胞生成牙骨质，成骨细胞生成骨（B对）；成熟牙骨质中的细胞位于牙骨质基质陷窝内，骨细胞位于骨陷窝内（C对）。牙骨质由细胞（D对）和矿化的细胞间质组成，无血管和神经。